男性，22岁，舌出现白色病损5年，加重半年。查：舌背左右侧，各可见两块约1.1～1.3厘米的白色斑块，边缘不整，下唇内侧黏膜有条形白纹。临床诊断应和哪种疾病相鉴别
A. 扁平苔藓
B. 白色念珠菌病
C. 单纯疱疹
D. 癌形溃疡
E. 球菌性口炎

正确答案：A。扁平苔藓

解析：本题考查口腔扁平苔藓的临床表现。扁平苔藓（OLP）病损为小丘疹连成的线状白色、灰白色花纹，病损大多左右对称，可发生在口腔黏膜任何部位（A对）。白色念珠菌感染为乳白色绒状假膜，不易剥脱（B错）。单纯疱疹：成簇集性小水疱为特征，疱壁薄，不久后破溃，形成浅表溃疡（C错）。癌形溃疡，溃疡深大，底部有菜花状细小颗粒突起，边缘隆起翻卷，扪诊有基底硬结，疼痛不明新（D错）。球菌性口炎病损有黄色假膜覆盖，假膜致密光滑，拭去假膜可见溢血的糜烂面（E错）。